关于超抗原的性质，哪一项是不正确的
A. 无MHC限制性
B. 需APC的加工和提呈
C. 产生极强的自身免疫应答
D. 超抗原激活T细胞的激活过程不涉及MHC限制
E. 分为外源性和内源性超抗原且分布广泛

正确答案：B。需APC的加工和提呈

解析：超抗原（S-Ag）是能够非特异性激活多克隆T细胞并能刺激其分泌大量细胞因子的抗原。超抗原激活T细胞的激活过程不涉及MHC限制，不需APC的加工和提呈，即无MHC限制性。只需极低浓度即可激活大量的T细胞克隆。产生极强的自身免疫应答。分为外源性和内源性超抗原且分布广泛。掌握“抗原基本概念、分类、超抗原及佐剂”知识点。